蛛网膜下腔出血SAH最具特征性的表现是
A. 血性脑脊液
B. 神经系统"三偏征"
C. 意识障碍
D. 四肢抽搐
E. 脑膜刺激征

正确答案：A。血性脑脊液

解析：SAH的临床表现为剧烈头痛，颈项强直，自我感觉为“撕裂样”或“电击样”头痛，常伴恶心、呕吐，严重时抽搐、意识不清，可有脑膜刺激征、单侧动眼神经麻痹、偏瘫、癫痫等，若有血性脑脊液，首先考虑是蛛网膜下腔出血（A对BCDE错）。